最容易引起淋巴结窦性组织细胞增生的疾病是
A. 传染性单核细胞增多症
B. 癌肿引流区的淋巴结
C. 药物过敏反应
D. 化脓性感染
E. 病毒接种不良反应

正确答案：B。癌肿引流区的淋巴结

解析：癌肿引流区的淋巴结易引起淋巴结窦性组织细胞增生的疾病（B对），窦组织细胞增生、淋巴滤泡增生和副皮质区增生均为慢性非特异性淋巴结炎淋巴结的病理变化。传染性单核细胞增多症、病毒接种不良反应、药物过敏反应可引起副皮质区增生（ACE错）。化脓性感染易引起急性非特异性淋巴结炎，造成滤泡生发中心可能会发生坏死，形成脓肿（D错）。